患者老年。无明显诱因突然昏仆，不省人事，半身不遂，目合口张，鼻鼾息微，遗尿，汗出，四肢厥冷，脉细弱。治疗应首选
A. 背俞穴，灸法
B. 足阳明经穴，灸法
C. 足厥阴经穴，针刺用泻法
D. 任脉经穴，灸法
E. 督脉经穴，灸法

正确答案：D。任脉经穴，灸法

解析：患者老年，无明显诱因突然昏仆，不省人事，半身不遂，目合口张，鼻鼾息微，遗尿，汗出，四肢厥冷，脉细弱。当辨证为中风，中脏腑脱证。脱证治疗当回阳固脱为主，穴位选取取任脉穴为主，气海、关元、神阙，用灸法（D对）；关元为任脉与足三阴经之会穴，为三焦元气所出，联系命门真阳；神阙为真气所系，用大艾柱重灸，以回垂绝之阳。背腧穴用灸法（A错）可以治疗相应脏腑的虚寒证；足阳明经用灸法（B错）可以治疗脾胃虚寒引起的临床病症；足厥阴肝经针刺用泻法（C错）可以治疗肝阳上亢的病证；督脉为阳脉之海，用灸法（E错）可以治疗全身的虚寒症状。